1岁半患儿多汗烦躁，前囟未闭，方颅，鸡胸，“Ｏ”形腿，血清钙、磷偏低，治疗主要
A. 手术纠正骨骼畸形
B. 口服钙片1～3g/d
C. 口服维生素D400IU/d
D. 口服维生素D4000IU/d，持续1个月后改用预防量
E. 口服维生素D10000IU/d，持续1个月后改用预防量

正确答案：D。口服维生素D4000IU/d，持续1个月后改用预防量

解析：治疗的目的为控制活动期，防止骨骼畸形。补充维生素D制剂口服法：每日给维生素D0.2万～0.4万IU，或1，25-（OH）2D3（罗盖全）0.5～2.0μg，连服2～4周后改为预防量，恢复期可用预防量维持。掌握“维生素D缺乏性佝偻病”知识点。